两侧存在第二乳磨牙，全口多个牙缺失，近期内继承恒牙即将萌出，不能习惯活动保持器者，应选择
A. 带环（全冠）丝圈保持器
B. Nance腭弓式间隙保持器
C. 远中导板保持器
D. 充填式保持器
E. 可摘式功能性保持器

正确答案：B。Nance腭弓式间隙保持器

解析：舌弓保持器和Nance腭弓式间隙保持器适应证：两侧都存在第二乳磨牙或第一恒磨牙，全口多个牙缺失，近期内继承恒牙即将萌出，或不能配合配戴功能性活动保持器者。因适时拔除第二乳磨牙需对其间隙进行保持时，该装置利用两个最远端的牙齿，焊接环绕整个牙弓的舌侧弓丝，保持牙弓周长不变。掌握“乳牙早失及间隙管理”知识点。